以下哪项会引起基因工程的遗传信息隐私权的伦理问题
A. 是否应该把研究结果告诉提供样本的人群
B. 携带“不良”遗传基因的人可能受到歧视
C. 有关疾病的遗传检测信息是否可以泄露给保险公司或用人单位
D. 如何保障提供样本的人的利益
E. 样本提供者应该是自愿地参与基因工程研究

正确答案：C。有关疾病的遗传检测信息是否可以泄露给保险公司或用人单位

解析：防止基因歧视，未经本人同意不得披露给单位（雇主）、保险公司、学校（C对B错）。必须保护医学样本提供者享有真正的知情同意权和利益分配（AD错）。要尊重人权、尊重人格尊严，贯彻自愿原则，应将诊断目的、结果、后果、风险等相关情况如实告诉受检者（E错）。